关于软膏剂的叙述，正确的有
A. 软膏剂不仅具有保护、润滑、局部治疗等作用，也可经皮吸收产生全身治疗作用
B. 凡士林、蜂蜡均属烃类基质
C. 凡士林常与羊毛脂合用以改善吸水性和渗透性
D. 以植物油、蜂蜡为基质的软膏，可用研合法制备
E. 制备徐长卿软膏时，处方药物丹皮酚宜先用少量液状石蜡研匀后再与基质混匀

正确答案：A、B、E。软膏剂不仅具有保护、润滑、局部治疗等作用，也可经皮吸收产生全身治疗作用；凡士林、蜂蜡均属烃类基质；制备徐长卿软膏时，处方药物丹皮酚宜先用少量液状石蜡研匀后再与基质混匀

解析：本题考查软膏剂的特点、组成及基质的质量要求。关于软膏剂的叙述，正确的有软膏剂不仅具有保护、润滑、局部治疗等作用，也可经皮吸收产生全身治疗作用（A对）；凡士林、蜂蜡均属烃类基质（B对）；制备徐长卿软膏时，处方药物丹皮酚宜先用少量液状石蜡研匀后再与基质混匀（E对）。软膏剂特点：软膏剂、乳膏剂多用于慢性皮肤病，具有保护创面、润滑皮肤和局部治疗作用；软膏中药物透皮吸收，也可产生全身治疗作用。软膏剂烃类基质：①凡士林：系液体与固体烃类形成的半固体混合物，有黄、白两种。油腻性大而吸水性较差（仅能吸水5%），故不宜用于有多量渗出液的患处。但与适量的羊毛脂、鲸蜡醇或胆甾醇等合用，可增加其吸水性。加入适量的表面活性剂可改善药物的释放与穿透性（C错）；②石蜡与液状石蜡：石蜡为多种固体烃的混合物，可与脂肪油、蜂蜡等熔合；液状石蜡是多种液体烃的混合物，能与多数脂肪油或挥发油混合。两者主要用于调节软膏稠度，液状石蜡还可用以研磨药物粉末，使易于与基质混匀。软膏剂【注意事项】不溶性药物或直接加入的药材：预先制成细粉，过六号筛。制备时取药粉先与少量基质或液体成分如液状石蜡、甘油、植物油等研成糊状（D错），再不断递加其余基质；或将药物细粉在不断搅拌下加到熔融的基质中，继续搅拌至冷凝。